某地妇女冬季喜围坐在煤炭炉旁做家务，致使其中部分中老年妇女经常出现鼻咽部、眼睛等刺激，与这些症状出现有关的最主要室内空气污染物是
A. SO₂
B. CO
C. 甲醛
D. IP
E. NO₂

正确答案：A。SO₂

解析：本题考查室内空气污染物。SO₂（A对BCDE错）是室内空气的主要污染物之一，可通过煤炭炉燃烧产生，其烟气中含有大量的有机硫化物，这些有机硫化物会进入室内空气，当人们长时间在室内吸入这些有机硫化物时，会造成鼻咽部、眼睛等刺激。